关于舌癌的叙述，哪项是错误的
A. 以鳞癌多见
B. 多发生于舌缘，恶性度高
C. 常发生早期颈部淋巴结转移
D. 舌尖部癌可以转移至颏下或直接至颈深中群淋巴结
E. 转移途径多为直接浸润和种植转移

正确答案：E。转移途径多为直接浸润和种植转移

解析：舌癌是最常见的口腔癌，男性多于女性，多数为鳞癌。多发生于舌侧缘，且恶性度较高，生长快，浸润性较强。常常发生早期颈淋巴结转移，且转移率较高。舌癌颈淋巴结转移常在一侧，位于舌侧缘的癌多向下颌下及颈深淋巴结上、中群转移；舌尖部癌可以转移至颏下或直接至颈深中群淋巴结。掌握“鳞状细胞癌概述及舌癌、牙龈癌”知识点。